下列有关佐剂的作用机制，说法错误的是
A. 激活固有免疫反应
B. 可以一种方式发挥作用
C. 可以延长抗原的潴留时间
D. 刺激促炎症细胞因子
E. AS04中的MPL是TLR4的激动剂

正确答案：B。可以一种方式发挥作用

解析：作用机制：佐剂可以多种方式发挥作用。佐剂可以延长抗原的潴留时间，铝佐剂（磷酸铝、氢氧化铝）和乳化剂（MF59）都有这种作用。佐剂激活固有免疫反应，如铝佐剂通过激活炎性小体引起免疫细胞释放IL-1β和IL-18；AS04中的MPL是TLR4的激动剂，可刺激促炎症细胞因子如TNF-a（肿瘤坏死因子-a）的产生。上述炎症环境可通过模拟病原体感染强力激活树突细胞（DCs）和巨噬细胞而促进抗原提呈。掌握“抗原基本概念、分类、超抗原及佐剂”知识点。